治疗暑湿袭表证之高热，应首选
A. 银翘散
B. 麻杏石甘汤
C. 甘露消毒丹
D. 新加香薷饮
E. 清骨散

正确答案：D。新加香薷饮

解析：新加香薷饮（D对）为香薷饮加扁豆花、金银花、连翘辛凉清轻之品，药性偏凉，以清热解暑见长，为辛温复辛凉之剂；主治夏月感寒夹湿，暑湿内蕴，寒轻暑重之证。银翘散（A错）主治温病初起，邪在卫分；麻杏石甘汤（B错）治疗外感风邪，邪热壅肺证；甘露消毒丹（C错）治疗湿温时热之湿热并重证；清骨散（E错）治疗肝肾阴虚，虚火内扰证。